下列哪种病变不能引起急腹症
A. 胃肠平滑肌痉挛
B. 急性弥漫性腹膜炎
C. 实质脏器破裂
D. 肠梗阻
E. 消化性溃疡病

正确答案：E。消化性溃疡病

解析：急腹症是指腹腔内、盆腔和腹膜后组织和脏器发生了急剧的病理变化，从而产生以腹部为主要症状和体征，同时伴有全身反应的临床综合征。胃肠平滑肌痉挛（A对）多见于小儿，是小儿急性腹痛中最为常见的机能性腹痛，属于小儿急腹症之一。急性弥漫性腹膜炎（B对）是由细菌感染、化学刺激或损伤所引起的外科常见的一种急腹症。实质脏器破裂（C对）多见于肝、脾，主要表现为腹膜内出血，属于急腹症的常见类型。肠梗阻（D对）的特点是肠内容物通过障碍，是常见的外科急腹症之一。消化性溃疡病（E错，为本题正确答案）指胃肠道黏膜被自身消化所形成的溃疡，可发生于食管、胃、十二指肠等，一般只有溃疡穿孔后才会引起急腹症。